第一恒磨牙窝沟封闭的适宜人群是
A. 婴儿
B. 幼儿
C. 老年人
D. 中年人
E. 学龄前期

正确答案：E。学龄前期

解析：本题考查窝沟封闭。第一恒磨牙窝沟封闭的适宜人群是学龄前期（E对）。窝沟封闭适应症：（1）有深窝沟的牙齿，特别是可以插入或卡住探针的牙（包括可疑龋）。（2）对侧同名牙已经患龋或有患龋倾向的牙。（3）乳磨牙以3-4岁为宜。（4）第一恒磨牙以6-7岁为宜。（5）双尖牙、第二恒磨牙一般以12-13岁为宜（第二恒磨牙在11～13岁为最适宜封闭的年龄）。（6）对口腔卫生不良的残疾儿童，时机放宽。行首次口腔检查应在婴儿（A错）。易患根面龋的人群是老年人（C错）。